临床出现自汗多尿，是气的哪一种功能减退的表现
A. 温煦与凉润作用
B. 推动与调控作用
C. 防御作用
D. 固摄作用
E. 中介作用

正确答案：D。固摄作用

解析：临床出现自汗多尿，说明人体的汗液和尿液出现滑脱流失，而气防止汗液和尿液等液态物质无故滑脱流失的作用称为气的固摄作用，故是气的固摄作用功能减退（D对）。气的防御作用是指气能护卫肌表，防御外邪入侵，同时也可以祛除侵入人体内的病邪（C错）。气的推动作用是指气中属阳部分（阳气）的激发、兴奋、促进等作用（B错）。